一定时期内，某人群中死于某病的频率
A. 患病率
B. 病死率
C. 续发率
D. 死亡率
E. 感染率

正确答案：D。死亡率

解析：死亡率指在一定期间（通常为1年）内，某人群中死于某病（或死于所有原因）的频率。掌握“流行病学资料与疾病分布”知识点。